女，58岁。摔倒左手背着地，左腕部肿胀疼痛。X线显示桡骨远端向掌侧桡侧移位，最可能的诊断是
A. Chance骨折
B. Jefferson骨折
C. Smith骨折
D. Barton骨折
E. Colles骨折

正确答案：C。Smith骨折

解析：本题主要考查不同英文命名的特殊骨折的X线表现。患者左手背部着地摔伤后，左腕部肿胀疼痛，X线示桡骨远端向掌侧桡侧移位，其最可能的诊断应为桡骨远端屈曲型骨折（即Smith骨折）（C对）。Colles骨折（E错）呈“银叉”畸形和“枪刺样”畸形，骨折远端向桡、背侧移位，近端向掌侧移位。Chance骨折（A错）和Jefferson骨折（B错）均为椎体的骨折。Barton骨折（D错）为桡骨远端关节面骨折伴腕关节脱位，临床表现为与Colles骨折相似的“银叉”畸形，骨折远端向桡、背侧移位，近端向掌侧移位。